女，45岁。1年来久站，长时间行走时，觉左下腹部胀痛不适。查体：T36.5℃，P80次／分，R18次／分。BP120/80mmHg，双肺呼吸音清，未闻及干湿性啰音，心律齐，腹软，无压痛，立位左腹股沟韧带下方内侧突起半球形肿物，平卧时可缩小，咳嗽时无明显冲击感，压迫内环后肿物仍可复出。该患者最适宜的手术方法是
A. Shouldice法疝修补术
B. McVay法疝修补术
C. Bassini法疝修补术
D. Halsted法疝修补术
E. Ferguson法疝修补术

正确答案：B。McVay法疝修补术

解析：45岁女性患者，1年来久站，长时间行走时觉左下腹部胀痛不适（股疝多见于40岁以上妇女，长期久站，长时间行走致腹压增大，对着股管上口的腹膜被下坠的腹内脏器推向下方，经股环向股管突出而形成股疝）。立位左腹股沟韧带下方内侧突起半球形肿物（卵圆窝位于腹股沟韧带内侧断的下方，股疝常在卵圆窝处表现为一半球形的突起）。平卧时可缩小，咳嗽无明显冲击感（股疝平卧可回纳内容物，疝囊颈小，咳嗽冲击感不明显）。综合该患者的病史、查体及临床表现，该患者诊断考虑为股疝。股疝最常用的手术是McVay法疝修补术（B对），此法可堵住股环用于修补股疝。Shouldice法（A错）（P313）用于加强内环，修补腹股沟管后壁，适用于较大的成人腹股沟斜疝和直疝。Bassini法（C错）（P313）、Halsted法（D错）（P313）均用于加强或修补腹股沟管后壁。Ferguson法（E错）（P313）用于加强腹股沟管前壁。